滴虫阴道炎的典型白带为
A. 均质稀薄灰白色
B. 白色稍厚呈凝乳或豆腐渣样
C. 稀薄脓性黄色泡沫状
D. 血性
E. 透明粘液性

正确答案：C。稀薄脓性黄色泡沫状

解析：滴虫阴道炎分泌物典型特点：稀薄脓性黄色泡沫状（C对）、有臭味。白色稠厚呈凝乳或豆腐渣样（P249）（B错）白带见于外阴阴道假丝酵母菌病。均质稀薄灰白色样（P251）（A错）白带见于细菌性阴道病。血性白带（P252）（D错）见于萎缩性阴道炎感染严重者。透明粘液性（八版诊断学P333）（E错）白带可见于排卵期、卵巢颗粒细胞癌和应用雌激素等药物治疗后。